对手术计划进行必要的调整属于
A. 术后正畸治疗
B. 追踪观察
C. 完成术前准备
D. 确认手术计划
E. 术前正畸治疗

正确答案：D。确认手术计划

解析：确认手术计划：手术前正畸治疗结束后，最后进行一次原手术计划的评估和预测；亦可对手术计划进行必要的调整或对正畸治疗作必要的补充，使即将进行的手术能更符合实际，取得最佳效果。掌握“牙颌面畸形”知识点。